患儿，3岁。反复浮肿2月余。实验室检查：尿蛋白（++++），镜检（-），尿蛋白定量>100mg/kg·d，血清白蛋白25g/L，胆固醇10.4mmol/L，血压正常，尿素氮正常。首先考虑的诊断是
A. 急性肾炎
B. 单纯性肾病综合征
C. 尿路感染
D. 肾盂肾炎
E. 急进性肾炎

正确答案：B。单纯性肾病综合征

解析：单纯性肾病综合征的诊断：大量蛋白尿（尿蛋白（+++～++++），24小时尿蛋白定量≥50mg/kg）；血浆白蛋白低于25g/L；血浆胆固醇高于5.7mmoL/L；不同程度的水肿。以上四项中以大量蛋白尿和低白蛋白血症为必要条件（B对）。急性肾小球肾炎多见于溶血性链球菌感染之后，病初表现为晨起双睑水肿，以后发展至下肢及全身，水肿为非凹陷性。可见肉眼血尿或镜下血尿（A错）。尿路感染表现为尿频、尿急、尿痛，膀胱或会阴部不适及尿道烧灼感（C错）。肾盂肾炎表现为发热寒战、恶心呕吐、腰痛，尿频尿急尿痛等（D错）。急进性肾炎临床标志是急性肾衰竭和活动性肾炎。可急骤起病但多数隐袭发病，初诊时常可见氮质血症，常以虚弱、疲劳和发热为最显著的症状，恶心、食欲不振、呕吐、关节痛、腹痛也常见。半数患者在发病前有流感样症状，发病后几周或几个月，肾功能恶化非常迅速，需要透析治疗（E错）。